整合在细菌染色体上的噬菌体的核酸是
A. 温和噬菌体
B. 毒性噬菌体
C. 前噬菌体
D. 溶原性细菌
E. L型细菌

正确答案：C。前噬菌体